男，40岁，干部。近1个月出现情绪低落，对工作及娱乐圈没有兴趣，卧床多，不思饮食，入睡困难，早醒，有轻生想法。目前治疗宜首选
A. 传统抗精神病药物
B. 非典型抗精神病药物
C. MAOI
D. 三环类抗抑郁药
E. SSRIs

正确答案：E。SSRIs

解析：该中年男性，近1个月以情绪低落为主要表现，对工作及娱乐圈没有兴趣，卧床多，不思饮食（食欲下降），入睡困难、早醒（睡眠障碍），有轻生想法（自杀观念），故诊断为抑郁发作，目前一般推荐SSRIs（选择性5-羟色胺再摄取抑制剂）作为一线治疗药物（E对）。传统抗精神病药物和非典型抗精神病药物为治疗精神分裂症的常用药物（AB错）。新型抗抑郁药物（SSRIs）与传统药物（三环类抗抑郁药）相比疗效相当，毒副作用小，使用安全，故首选SSRIs（D错）。MAOI（单胺氧化抑制剂）作为二线药物主要用于三环类或其他药物治疗无效的抑郁症，不作首选（C错）。